发生慢性中毒的基本条件是毒物的
A. 剂量
B. 作用时间
C. 选择作用
D. 蓄积作用

正确答案：D。蓄积作用

解析：本题考查发生慢性中毒的基本条件。发生慢性中毒的基本条件是毒物的蓄积作用（D对ABC错）。化学毒物的蓄积作用是指当外源化学物连续地、反复地进入机体，而且吸收速度（或总量）超过代谢转化排出的速度（或总量）时，化学毒物或其代谢物在机体内逐渐增加和蓄积的现象。